患者，女，28岁，已婚。产后恶露量多，过期不止，色深红，质稠黏而臭秽，口干咽燥，面色潮红。其证候是
A. 气虚
B. 血虚
C. 血热
D. 湿热
E. 血瘀

正确答案：C。血热

解析：题中患者产后恶露量多，过期不止，故诊断为产后恶露不绝。产后恶露量多，过期不止，色深红，质稠黏而臭秽为阴虚内热，热扰冲任，迫血下行，所致。阴液不足，津不上乘，故口燥咽干，虚火上炎，故面色潮红。故辨为血热证。气虚恶露多色淡，质稀，无臭气，伴面色（白光）白，神疲懒言，小腹空坠等（A错）。血虚多伴面色淡白或萎黄，心悸，神疲等，且血虚不导致产后恶露不绝（B错）。题中辨为血热证（C对）。湿热多有身热、口苦、胸闷脘痞、小便黄等症状（D错）。血瘀者恶露量可多可少，其中有血块，有小腹疼痛拒按的症状（E错）。